精神分裂症常见的注意障碍是
A. 注意增强
B. 妄想消退
C. 注意衰退
D. 注意涣散
E. 注意转移

正确答案：C。注意衰退